患者，男，68岁。家属代诉患者于今日下午外出散步，突然昏仆，不省人事，半身不遂，目合口张，鼻鼾息微，遗尿，汗出，四肢厥冷，脉细弱。治疗应首选
A. 督脉经穴，灸法
B. 任脉经穴，灸法
C. 背俞穴，灸法
D. 足阳明经穴，灸法
E. 足厥阴经穴，针刺用泻法

正确答案：B。任脉经穴，灸法

解析：本题考查常见的病症的辩证、处方。题中患者于今日下午外出散步，突然昏仆，不省人事，半身不遂，目合口张，鼻鼾息微，遗尿，汗出，四肢厥冷，脉细弱，可诊断为中风脱证。针刺督脉经穴可用于治疗腰痛,腹痛,泄泻,痢疾,脱肛等（A错）。针刺任脉经穴主治少腹，脐腹，胃脘，胸，颈，咽喉，头面等局部病证和相应的内脏病证，部分腧穴有强壮作用或可治疗神志病（B对）。背俞穴可用于治疗与该脏腑有相关联系的五官病、肢体病（C错）。针刺足阳明经穴可用于胃痛胃酸等病症（D错）。针刺厥阴经穴可用于治疗前列腺增生等病症（E错）。